关于肾病综合征的说法，错误的是
A. 可分为原发性和继发性
B. 尿蛋白定量超过3.5g/d
C. 血浆蛋白低于30g/L
D. 没有水肿
E. 高血脂症

正确答案：D。没有水肿

解析：肾病综合征可分为原发性、继发性两大类。任何年龄均可发生，男性患者多于女性。诊断标准为：尿蛋白定量超过3.5g/d；血浆蛋白低于30g/L；水肿；高脂血症；其中前两项为诊断所必须的。掌握“慢性肾小球肾炎、肾病综合征”知识点。